有关阴囊的说法，不正确的是
A. 位于阴茎之后下方
B. 其壁由皮肤和肉膜组成
C. 温度增高时，平滑肌收缩，壁紧缩增厚
D. 肉膜内含大量平滑肌
E. 肉膜向正中处伸入形成阴囊中隔

正确答案：C。温度增高时，平滑肌收缩，壁紧缩增厚

解析：阴囊位于阴茎后下方（A对）。其壁由皮肤和肉膜组成（B对）。肉膜内含有平滑肌（D对）纤维，随外界温度变化而舒缩（C错）以调节阴囊内的温度。肉膜向正中处伸入形成阴囊中隔（E对）。